再灌注时发生钙超载与下列哪一项有关？
A. 细胞膜通透性降低
B. 细胞膜外板与糖被膜分离
C. 钙泵功能加强
D. 线粒体功能加强
E. 再灌注液内钙浓度过低

正确答案：B。细胞膜外板与糖被膜分离

解析：细胞膜外板与糖被膜分离（B对）出现在再灌注时发生钙超载时，缺血－再灌细胞膜损伤引起钙超载的机制是：心细胞膜正常结构被破坏，对Ca2+通透性增强（A错）；①再灌注时生成大量的自由基，使细胞膜的脂质过氧化，加重膜结构的破坏；②细胞内Ca2+增加激活磷脂酶，使膜磷脂降解，进一步增加细胞膜对Ca2+的通透性，共同促使胞质Ca2+浓度升高。(2)线粒体膜损伤（D错）。降低再灌注液的速度、压力、温度、pH值及Ca2+（E错）、N a+含量，能减轻再灌注损伤。(3)内质网膜损伤：内质网钙摄取是依赖水解ATP的主动转运过程。自由基的作用及膜磷脂的降解可造成内质网膜损伤，使其钙泵功能障碍（C错），对Ca2+摄取减少，引起胞质Ca2+浓度升高。